男，30岁。约1年时间孤僻、寡言，近期由于被上级批评后出现失眠，不上班并紧闭门窗，声称有人监视自己，在家中不敢谈话，说家中已被安装窃听器，公安局也要逮捕自己，不吃妻子做的饭食，认为妻子已同他人合伙在饭菜中放了毒药。因此殴打妻子。本病例最可能的诊断是
A. 精神分裂症紧张型
B. 精神分裂症偏执型
C. 抑郁症
D. 反应性精神病
E. 躁狂症

正确答案：B。精神分裂症偏执型

解析：中青年男性，约1年时间孤僻、寡言（抑郁症状），近期由于被上级批评后出现失眠，不上班并紧闭门窗，声称有人监视自己（典型的幻觉症状），在家中不敢谈话，说家中已被安装窃听器，公安局也要逮捕自己，不吃妻子做的饭食，认为妻子已同他人合伙在饭菜中放了毒药（典型的被害妄想症状），因此殴打妻子，根据患者的临床症状及体征，考虑最可能的诊断为精神分裂症，由于该病例是成人+阳性症状，所以应诊断为偏执型（B对），精神分裂症紧张型（A错）存在木僵、蜡样屈曲的典型表现。抑郁症（C错）主要表现为无望、无助、无能力；自责、自罪、自杀。反应性精神病（D错）是因剧烈的或者持久的精神紧张、精神创伤引起的精神活动异常。本病以明显的妄想或严重的情绪障碍为主要症状。躁狂症（E错）主要表现为情感高涨、思维奔逸和活动增多。